这是某中学初中三年级的每周课表：此课表中没有遵循课程难易程度原则的是
A. 星期一第五节英语
B. 星期二第五节地理
C. 星期三第一节历史
D. 星期四第五节英语
E. 星期四第六节数学

正确答案：E。星期四第六节数学